下列不属于社区卫生服务工作内容的是
A. 健康教育
B. 血吸虫防治
C. 器官移植
D. 免疫接种
E. 外伤处理

正确答案：C。器官移植

解析：本题考查社区卫生服务的内容。社区卫生服务的内容具体可分为基本公共卫生服务和基本医疗服务两个部分。1.基本公共卫生服务：包括（1）建立居民健康档案；（2）健康教育（A对）；（3）预防接种（D对）；（4）儿童健康管理；（5）孕产妇健康管理；（6）老年人健康管理；（7）慢性病病入健康管理；（8）重性精神疾病（严重精神障碍）病人管理；（9）结核病病人健康管理；（10）中医药健康管理；（11）传染病和突发公共卫生事件报告和处理（B对）；（12）卫生监督协管。2.基本医疗服务：包括（1）一般常见病、多发病诊疗、护理和诊断明确的慢性病治疗；（2）社区现场应急救护（E对）；（3）家庭出诊、家庭护理、家庭病床等家庭医疗服务；(4)转诊服务；（5）康复医疗服务；（6）定期的体检和疾病筛检服务；（7）中医药（民族医药）服务；（8）政府卫生行政部门批准的其他适宜医疗服务。器官移植（C错，为本题正确答案）不属于社区卫生服务工作内容。